酮体是由
A. 脂肪酸在脂肪组织内进行分解代谢产生
B. 脂肪酸在肝内进行正常分解代谢产生
C. 脂肪组织在肝内进行正常分解代谢产生
D. 脂肪酸在小肠内进行正常分解代谢产生
E. 脂肪组织在小肠内进行正常分解代谢产生

正确答案：B。脂肪酸在肝内进行正常分解代谢产生

解析：酮体是脂肪酸在肝内进行正常分解代谢时所产生的特殊中间产物，包括乙酰乙酸、β-羟丁酸和丙酮三种物质。酮体是肝内生成肝外利用。掌握“脂肪的分解代谢”知识点。